早期慢性支气管炎肺部X线表现是
A. 无特殊征象
B. 双肺纹理增粗、紊乱
C. 肺野透亮度增加
D. 隔肌下降
E. 胸部扩张、肋间增宽

正确答案：A。无特殊征象

解析：慢性支气管炎简称慢支，是气管、支气管黏膜及其周围组织的慢性非特异性炎症。临床上以咳嗽、咳痰为主要症状，实验室和其他辅助检查，X线检查早期可无异常（A对），反复发作者表现为肺纹理增粗、紊乱，呈网状或条索状、斑点状阴影，以双下肺明显。